保护易感人群的措施
A. 到2025年腹泻导致的死亡率降到1‰以下
B. 前六个月纯母乳喂养婴儿
C. “三管一灭”
D. 设立腹泻病门诊
E. 轮状病毒疫苗接种

正确答案：E。轮状病毒疫苗接种

解析：本题考查保护感染性腹泻易感人群的措施。保护感染性腹泻易感人群的措施有：1.疫苗预防（E对ABCD错）：疫苗预防是保护易感人群的有效手段；2.药物预防：原则上不提倡使用药物预防，但当流行特别严重时，为控制流行局势可考虑对密切接触者等小范围内使用。3.其他措施：开展广泛的卫生宣传教育，普及卫生防病知识，动员全社会参与和提高个体自我保护能力等。